含有手性碳原子的抗寄生虫药物有
A. 阿苯达唑
B. 乙胺嘧啶
C. 二盐酸奎宁
D. 磷酸伯氨喹
E. 蒿甲醚

正确答案：C、D、E。二盐酸奎宁；磷酸伯氨喹；蒿甲醚

解析：本题考查抗寄生虫药。含有手性碳原子的抗寄生虫药有二盐酸奎宁（C对）、磷酸伯氨喹（D对）、蒿甲醚（E对）。奎宁的分子可由两部分组成，喹啉及喹核碱通过甲醇与哌啶环相连。分子中有四个手性碳，即C-3、C-4、C-8和C-9，其光学立体异构活性各不相同。磷酸伯氨喹为8-氨基喹啉类药物，在体内转变为较强氧化性能的喹啉醌衍生物，有手性碳原子。蒿甲醚，为对青蒿素进行改造得到的半合成抗疟药，含有手性碳原子，其结构有α型和β型两种构型，临床上用α型和β型的混合物，但以β型为主。阿苯达唑（A错）和乙胺嘧啶（B错）都不含手性碳原子。